肾衰患者不必调整剂量，在体内迅速代谢，其代谢物虽在体内积蓄但不显毒性的药物是
A. 萘啶酸
B. 庆大霉素
C. 黄连素
D. 异烟肼
E. 利福平

正确答案：A。萘啶酸